其“恶性”主要表现在临床行为，而不在组织学特点的恶性上皮性牙源肿瘤是
A. 成釉细胞癌-原发型
B. 成釉细胞癌-继发型
C. 成釉细胞癌-去分化型
D. 牙源性角化囊性瘤
E. 转移性（恶性）成釉细胞瘤

正确答案：E。转移性（恶性）成釉细胞瘤

解析：恶性上皮性牙源肿瘤中还有一种为转移性（恶性）成釉细胞瘤，其“恶性”主要表现在临床行为，而不在组织学特点。掌握“成釉细胞癌”知识点。